最可能是特异性感染的是
A. 疖病
B. 臀部脓肿
C. 腰椎旁冷脓肿
D. 下肢丹毒
E. 急性肝脓肿

正确答案：C。腰椎旁冷脓肿